发挥作用最慢的利尿药是
A. 氢氯噻嗪
B. 呋塞米
C. 氨苯蝶啶
D. 螺内酯
E. 阿米洛利

正确答案：D。螺内酯